在农村，发现乙类传染病病人或疑似病人时，应在多少小时内报告给发病地区所属的卫生防疫机构
A. 6小时内
B. 12小时内
C. 24小时内
D. 36小时内
E. 48小时内

正确答案：C。24小时内

解析：本题考查疫情报告制度。《中华人民共和国传染病防治法》规定，其他乙、丙类传染病病人、疑似病人和规定报告的传染病病原携带者，实行网络直报的责任报告单位应于病例诊断后24小时（C对ABDE错）内进行网络报告。